HLA–I类基因区不包括
A. HIA–A
B. HIA–B
C. HIA–C
D. HIA–H
E. HIA–DR

正确答案：E。HIA–DR